女性，23岁，产后23天，左乳房肿痛，伴发热恶寒，口干，舌红苔薄黄，脉浮数。查体：左乳外上象限可扪及一硬决，皮肤微红压痛，诊断为急性乳腺炎，治疗应首选青霉素加
A. 瓜蒌牛蒡汤
B. 黄连清解汤
C. 四妙散
D. 黄连解毒汤
E. 仙方活命饮

正确答案：A。瓜蒌牛蒡汤

解析：患者女，23岁，产后23天，左乳房肿痛，查体：左乳外上象限可扪及一硬决，皮肤微红压痛，可诊断为急性乳腺炎。发热恶寒，口干，舌红苔薄黄，脉浮数，诊断为肝胃郁热证。用瓜萎牛蒡汤以疏肝清胃，通乳消肿（A对）。黄连清解汤可以清热，治疗热性病证（B错）。四妙散具有清热利湿，舒筋壮骨之功效，主治湿热痿证（C错）。黄连解毒汤具有清热解毒之功效，主治三焦火毒证（D错）。仙方活命饮具有清热解毒，消肿散结，活血止痛之功效，主治阳证痈疡肿毒初起（E错）。